由县级以上人民政府报经上一级政府决定可以在传染病学流行时采取的紧急措施是
A. 停工停业停课
B. 实施交通检疫
C. 隔离治疗
D. 强制隔离
E. 指定场所进行医学观察

正确答案：A。停工停业停课

解析：由县级以上人民政府报经上一级政府决定可以采取下列紧急措施并予以公告：①限制或者停止集市、剧院演出或者其他人群聚集的活动；②停工、停业、停课（A对）；③封闭或者封存被传染病病原体污染的公共饮用水源、食品以及相关物品；④控制或者扑杀染疫野生动物、家畜家禽；⑤封闭可能造成传染病扩散的场所（BCDE错）。